下列哪种药品不属于假药
A. 药品所含成分与国家药品标准规定的成分不符
B. 药品所标明的适应症或者主治超出规定范围
C. 过期的药品
D. 变质的药品
E. 以非药品冒充药品或者以他种药品冒充此种药品

正确答案：C。过期的药品

解析：假药，是指药品所含成分与国家药品标准规定的成分不符（A对），以及以非药品冒充药品或者以他种药品冒充此种药品的（E对）。《药品管理法》规定，有下列情形之一的药品按假药论处：①国务院药品监督管理部门规定禁止使用的；②依照《药品管理法》必须批准而未经批准生产、进口，或者依法必须检验而未经检验即销售的；③变质的（D对）；④被污染的；⑤使用依照《药品管理法》必须取得批准文号而未取得批准文号的原料药生产的；⑥所标明的适应证或者功能主治超出规定范围的（B对）。过期的药品属于劣药（C错，为本题正确答案）。